处方药名枇杷叶，调配应当付的是
A. 生品
B. 酒炙品
C. 蜜炙品
D. 醋炙品
E. 姜炙品

正确答案：C。蜜炙品

解析：本题考查的是常见的处方应付实例。处方药名枇杷叶，调配应当付的是蜜炙品（C对）。常见的处方应付实例：（1）处方直接写药名（或炒），需调配清炒品，如紫苏子、莱菔子、谷芽、麦芽、王不留行、酸枣仁、蔓荆子、苍耳子、牛蒡子、白芥子等。（2）处方直接写药名（或炒），需调配麸炒品，如僵蚕、白术、枳壳等。（3）处方直接写药名（或制），需调配炮制品，如草乌（水制）、川乌（水制）、天南星（矾制）、附子（炮制）、吴茱萸（甘草水制）、远志（甘草水制去心）、厚朴（姜制（E错））、何首乌等。（4）处方直接写药名（或炒或炙），需调配烫制品，如龟甲、鳖甲、穿山甲等。（5）处方直接写药名（或煅），需调配煅制品，如花蕊石、钟乳石、自然铜、金礞石、青礞石、瓦楞子等。（6）处方直接写药名（或炒或炭），需调配炭制品，如干漆、炮姜、地榆、侧柏叶、蒲黄等。（7）处方直接写药名（或炒或炙），需调配蜜炙品，如枇杷叶、马兜铃等。（8）处方直接写药名（或炒或炙），需调配醋炙品（D错），如延胡索等。（9）处方直接写药名（或炒或炙），需调配盐炙品，如补骨脂、益智仁等。生品（A错），一般情况下，处方直接写药名，需调配生品。酒炙品（B错）的处方标注方式，2022年考试指南未明确说明。